患儿，1岁，因食欲差，母乳少，以米糊稀饭喂养，未添加其他辅食，诊断为营养不良Ⅰ度。最先出现的症状是
A. 身长低于正常
B. 体重不增
C. 皮肤干燥
D. 皮下脂肪减少
E. 肌张力低下

正确答案：B。体重不增

解析：该病例诊断为营养不良1度，说明患儿仍处于营养不良的早期。营养不良多见于1岁以内的婴儿，体重不增是最早出现的症状（B对）。随着营养不良的加重，才会出现身长低于正常（A错）、皮肤干燥（C错）、皮下脂肪减少（D错）、肌张力低下（E错）。